患者妊娠2个月。食少便软，面色萎白，语声低微，四肢乏力，舌质淡，脉细缓。治疗应首选
A. 四物汤
B. 归脾汤
C. 当归补血汤
D. 四君子汤
E. 八珍汤

正确答案：D。四君子汤

解析：患者“食少便软”是由于脾胃气虚，其受纳、健运乏力，且湿浊内生；脾主肌肉，脾胃气虚，四肢肌肉无所禀受，故四肢乏力；气血生活不足，故面色萎白；脾为肺之母，脾胃一虚，肺气先绝，故语声低微；舌质淡，脉细缓亦为气虚之象。四君子汤主治脾胃气虚证，脾为气血生化之源，其气虚，则乏力倦怠，脾气不升，气血不法濡润头面，则面色萎白；故治疗时应选用四君子汤益气健脾（D对）。四物汤主治营血虚滞证，不治疗气虚（A错）。归脾汤主治心脾气血两虚证与脾不统血证，而本题所给的临床表现不单指心脾的气血两虚并且也没有出血的表现，所以可以排除（B错）。当归补血汤主治血虚阳浮发热证，而本题所给的临床表现没有热像，可以排除（C错）。八珍汤益气补血，主治气血两虚证（E错）。